全面监测、评价、分析预测个人的健康危险因素，向人们提供有针对性的健康咨询指导的方法是
A. 生命质量评价
B. 健康危险因素评价
C. 综合健康评价
D. 健康管理
E. 社区卫生服务

正确答案：D。健康管理